工人的健康是否受损最终取决于
A. 生物监测
B. 环境监测
C. 防护设施效果评价
D. 医学检查
E. 生物效应监测

正确答案：D。医学检查